具有生津止渴功效的药物是
A. 生地黄
B. 牡丹皮
C. 赤芍
D. 紫草
E. 金银花

正确答案：A。生地黄

解析：该题考查生地黄的功效，属记忆内容。生地黄味甘，苦，性寒；入心、肝、肾经；具有清热凉血，养阴生津的功效（A对）。牡丹皮具有清热凉血，活血祛瘀的功效，没有生津止渴的功效（B错）。赤芍具有清热凉血，散瘀止痛的功效，没有生津止渴的功效（C错）。紫草具有清热凉血，活血，解毒透疹的功效，没有生津止渴的功效（D错）。金银花具有清热解毒，疏散风热的功效，没有生津止渴的功效（E错）。